骨软骨瘤的好发部位是
A. 长骨干骺端
B. 扁骨骨端
C. 手足的管状骨
D. 短状骨骨端
E. 短骨干骺端

正确答案：A。长骨干骺端

解析：骨软骨瘤：为常见的良性骨肿瘤之一。多见于青年人。好发于胫骨、腓骨、肱骨的近端及股骨远端的干骺端。可单发，也可多发（A对BE错）。软骨瘤好发于于手足的短管状骨的骨髓腔（C错）。结核分枝杆菌侵及短管状骨引起的结核病变。其中手骨结核最常见（D错）。